胸膜腔
A. 由脏胸膜围成
B. 由壁胸膜围成
C. 左、右肺分别位于左、右胸膜腔内
D. 左、右胸膜腔互不相通
E. 无

正确答案：D。左、右胸膜腔互不相通

解析：胸膜腔是壁、脏两层胸膜之间围成的腔隙（AB错）。肺位于胸腔内（C错）。左、右胸膜腔互不相通 （D对）。